病毒性脑炎的常见病因是
A. 外感寒湿
B. 外感湿热
C. 感受温热毒邪
D. 饮食不洁
E. 感受暑湿

正确答案：C。感受温热毒邪

解析：中医认为，本病的发生是由于人体正气亏虚，夏季暑热邪气乘虚侵袭人体所致（C对）；本病中医学属暑温，本病的发生是由于暑热之邪而非寒邪（A错）；本病主要病因为暑热，其次暑热夹湿造成湿邪中阻（B错）；本病病因为外感暑热之邪与饮食无关（D错）；本病首先为感染暑热而致病，其次暑热夹湿酿成暑湿（E错）。